苏子降气汤组成中不包含的药物是
A. 当归
B. 肉桂
C. 前胡
D. 厚朴
E. 葶苈子

正确答案：E。葶苈子

解析：本题考查苏子降气汤的组成。苏子降气汤为理气剂中的降气剂由紫苏子、半夏、当归、甘草、前胡、厚朴、肉桂组成（ABCD错）。葶苈子不属于苏子降气汤的药物组成（E对）。记忆：苏大官盛夏前后归国。―苏大官生夏前厚归国。